某男，45岁。患风湿痹痛10年，近日又被毒蛇咬伤。宜选用的药是
A. 防己
B. 雷公藤
C. 伸筋草
D. 千年健
E. 徐长卿

正确答案：E。徐长卿

解析：本题考查的是徐长卿的主治病证。宜选用的药是徐长卿（E对）。徐长卿【主治病证】（1）风湿痹痛，脘腹痛，牙痛，术后痛，癌肿痛。（2）跌打肿痛。（3）风疹，湿疹，顽癣。（4）毒蛇咬伤。防己（A错）【主治病证】（1）风湿痹痛，尤以热痹为佳。（2）水肿，腹水，脚气浮肿，小便不利。雷公藤（B错）【主治病证】（1）风湿顽痹，拘挛疼痛。（2）疔疮肿毒，腰带疮，湿疹，麻风，疥癣。伸筋草（C错）【主治病证】（1）风湿痹痛，关节酸痛，屈伸不利。（2）跌打损伤。千年健（D错）【主治病证】风寒湿痹，腰膝冷痛，下肢拘挛麻木。